好发于儿童及青少年的卵巢肿瘤是
A. 性索间质肿瘤
B. 生殖细胞肿瘤
C. 上皮性肿瘤
D. 转移性癌
E. 非特异性间质瘤

正确答案：B。生殖细胞肿瘤

解析：好发于儿童及青少年的卵巢肿瘤是生殖细胞肿瘤（B对），其是来源于原始生殖细胞的一组肿瘤，青春期前患者占60%～90%，绝经后患者仅占4%。性索间质肿瘤（P330）（A错）病理上可分为颗粒细胞-间质细胞瘤和支持细胞-间质细胞瘤，其中颗粒细胞-间质细胞瘤又可分为颗粒细胞瘤（95%为成人型，5%为幼年型）、卵泡膜细胞瘤（成年妇女多见）、纤维瘤（多见于中年妇女）；支持细胞-间质细胞瘤多见于40岁以下妇女。卵巢上皮性肿瘤（P326）（C错）多见于中老年妇女，极少发生在青春期前或婴幼儿期。转移性癌（D错）多发生于成年妇女；非特异性间质瘤（E错）可发生于任何年龄，但成年人更多见。